女性，38岁。洗衣时突发右侧肢体活动不灵，查体：意识清，失语，二尖瓣区可闻及双期杂音，心律不齐，右侧偏瘫，上肢重于下肢，偏身痛觉减退，首先考虑的诊断是
A. 脑血栓形成
B. 脑栓塞
C. 脑出血
D. 蛛网膜下腔出血
E. 短暂性脑缺血发作

正确答案：B。脑栓塞

解析：青年女性，活动中突发右侧偏瘫、偏身痛觉减退和失语等，查体二尖瓣区可闻及双期杂音及心律不齐，考虑二尖瓣狭窄并关闭不全，为心源性栓子脱落造成脑栓塞的高危因素。根据活动中骤然起病，出现偏瘫、失语等局灶性神经功能缺损，既往有栓子来源的基础疾病，首先考虑诊断为脑栓塞（B对）。脑栓塞以青壮年发病多见，主要由于心源性疾病的栓子随血流进入颅内动脉引起，临床典型表现为活动中突然起病，出现不同程度的偏瘫、失语等局灶性神经功能缺损表现。脑血栓形成（A错）多见于中老年，常在安静或睡眠中发病（P177）。脑出血（C错）多见于50岁以上的高血压患者，多在寒冷季节和情绪激动时发病（P189）。蛛网膜下腔出血（D错）会有典型的剧烈头痛、脑膜刺激征和眼部症状等临床表现（P194）。短暂性脑缺血发作（E错）典型临床表现为发作突然，持续时间短，呈反复刻板性发作，且无后遗症及责任病灶（P173）。